盐酸克伦特罗是
A. 禁止用于所有食品动物的兽药
B. 不需要制定最高残留限量的兽药
C. 需要制定最高残留限量的兽药
D. 需要制定最低残留限量的兽药
E. 不得检出兽药残留的兽药

正确答案：A。禁止用于所有食品动物的兽药

解析：本题考查盐酸克伦特罗。盐酸克伦特罗（A对BCDE错）又称瘦肉精，是农业部明文规定禁止用于所有食品动物的兽药。